里-斯细胞。最大可能诊断是
A. 结核性淋巴结炎
B. 慢性淋巴细胞白血病
C. 癌转移
D. 淋巴瘤
E. 风湿性疾病

正确答案：D。淋巴瘤

解析：患者中青年男性，高热、皮肤瘙痒半月（霍奇金淋巴瘤常见发热、盗汗、瘙痒及消瘦等全身症状），右颈及锁骨上淋巴结肿大，无压痛，互相粘连（无痛性颈部或锁骨上淋巴结肿大常为霍奇金淋巴瘤的首发症状），血红蛋白90g/L（成年男性正常Hb120～160g/L），提示贫血，白细胞10×10⁹/L（正常4～10×10⁹/L）正常，中性66%（正常50%～75%），淋巴24%（正常20%～40%），白细胞比例正常，骨髓涂片找到里-斯细胞（里-斯细胞即R-S细胞，对霍奇金淋巴瘤的病理组织学诊断有重要价值），提示霍奇金淋巴瘤的骨髓浸润，故患者最可能的诊断是霍奇金淋巴瘤（D对）。结核性淋巴结炎（A错）常有低热、盗汗、消瘦等结核中毒症状，血常规淋巴细胞比例增高；慢性淋巴细胞白血病（P580）（B错）常有淋巴结肿大，无痛性，但一般无粘连，血中白细胞＞10×10⁹/L，淋巴细胞比例增高≥50%；癌转移（C错）常有原发肿瘤的临床表现；风湿性疾病（E错）无淋巴结肿大。